井水作为饮用水时，下列关于井址选择错误的是
A. 水井设在地下水污染源上游
B. 地势高燥
C. 不易积水
D. 周围30～50m内无粪坑
E. 周围20～30m内无渗水厕所

正确答案：D。周围30～50m内无粪坑

解析：本题考查井址的选择。井址的选择应从水量、水质及便于防护和使用等方面加以考虑。 为了防止污染，水井应尽可能设在地下水污染源上游（A对），地势高燥（B对），不易积水（C对），周围20～30m内无渗水厕所（E对）、粪坑（D错，为本题正确答案）、垃圾堆等污染源。